阿尔茨海默病患者应该避免使用的药物是
A. 美金刚
B. 卡巴拉汀
C. 颠茄
D. 多奈哌齐
E. 加兰他敏

正确答案：C。颠茄

解析：本题考查抗阿尔茨海默病用药。阿尔茨海默病患者应该避免使用的药物是颠茄（C错，为本题正确答案）。颠茄是抗胆碱药，用于胃及十二指肠溃疡，胃肠道、肾、胆绞痛等。美金刚（A对）、卡巴拉汀（B对）、多奈哌齐（D对）、加兰他敏（E对）为改善认知功能的药物，阿尔茨海默病患者可以使用。